地龙中具有平喘作用的成分有
A. 蚯蚓解热碱
B. 次黄嘌呤
C. 蚯蚓素
D. 琥珀酸
E. 蚯蚓毒素

正确答案：B、D。次黄嘌呤；琥珀酸

解析：本题考查的是地龙的成分。地龙中具有平喘作用的成分有次黄嘌呤（B对）、琥珀酸（D对）。地龙【成分】主含蛋白质，其组成中含18～20种氨基酸；脂类成分，均含有18种脂肪酸，其中油酸、硬脂酸和花生烯酸的含量最高，占总脂肪酸量的50%左右，品种间各组分含量有显著差异。另含琥珀酸，具平喘、利尿作用；次黄嘌呤，具平喘、降压作用；蚯蚓解热碱（A错），具解热作用；蚯蚓素（C错），具溶血作用；地龙毒素（E错），有毒性；微量元素Zn、Fe、Ca、Mg、Cu等。又从地龙中提取分离出有溶栓作用的蚓激酶、纤溶酶、地龙溶栓酶、胆碱酯酶及过氧化氢酶。